真菌引起阴道炎
A. 咪康唑
B. 甲硝唑
C. 庆大霉素
D. 聚甲酚磺醛
E. 曲古霉素

正确答案：A。咪康唑

解析：本题考查阴道炎治疗药。真菌性阴道炎：常选用制霉菌素、克霉唑、咪康唑、益康唑栓剂，首选硝酸咪康唑栓（A对），次选克霉唑栓。甲硝唑（B错）是滴虫性阴道炎的主要治疗药物。庆大霉素（C错）适用于敏感革兰阴性杆菌，如大肠埃希菌、克雷伯菌属、铜绿假单胞菌以及葡萄球菌甲氧西林敏感株所致的严重感染，如败血症等。聚甲酚磺醛（D错）用于滴虫、细菌、真菌引起的阴道感染。曲古霉素（E错）用于滴虫、阿米巴原虫及念珠菌混合感染阴道炎。